男性，35岁。双下肢水肿2周，查体：血压130/80mmHg，双下肢轻度凹陷。尿常规：蛋白（+++），红细胞（++），Crl221umol/L，血浆白蛋白28g/L。为明确诊断不需要的检查项目是
A. 肾活检
B. 双肾超声
C. 肾CT
D. 尿蛋白定量
E. 血脂

正确答案：C。肾CT

解析：根据该患者双下肢水肿，尿蛋白（+++），出现血尿红细胞（++），血浆白蛋白28g/L（＜30g/L）应考虑肾病综合征。肾活检（A错）可以明确病变的病理类型，为肾病综合征的诊断提供依据。双肾超声（B错）有助于排除诊断。尿蛋白定量（D错）若大于3.5g/d，则支持肾病综合征的诊断。血脂（E错）增高是肾病综合征的诊断标准之一。肾CT（C对）对于诊断肾病综合征意义不大。